男，20岁，农民。因高热伴腰痛4天，无尿2天，于11月22日来诊。查体：体温39.6℃，血压75/55mmHg，意识清楚，颈软，球结膜充血，右上肢散在小出血点。血白细胞18.5×10⁹/L，N0.73，L0.13，异型淋巴细胞0.14。尿蛋白（++++）。血小板为6.8×10⁹/L。最可能的诊断是
A. 中毒型菌痢
B. 流行性出血热
C. 败血症
D. 伤寒
E. 流行性脑脊髓膜炎

正确答案：B。流行性出血热

解析：患者，男性青年，农民（男性青壮年农民为流行性出血热的易感人群），因高热伴腰痛（发热期的表现）4天，无尿（少尿期的表现）2天，于11月22日来诊。查体：体温39.6℃（发热常在39～40℃之间，正常值为36.0～37.2℃），血压75/55mmHg（血压下降为低血压休克期的表现，正常值为90～140/60～90mmHg），意识清楚，颈软，球结膜充血，右上肢散在小出血点（毛细血管损伤的表现）。血白细胞18.5×10⁹/L（白细胞升高，正常值为4～10×10⁹/L），N 0.73，L 0.13，异型淋巴细胞0.14（出现较多的异型淋巴细胞），血小板为6.8×10⁹/L（血小板减少，正常值为100～300×10⁹/L），尿蛋白（++++）（肾损害的表现），综合患者病史、症状、体查及实验室检查，最可能的诊断是流行性出血热（B对）。中毒性菌痢（P180）（A错）以2～7岁多见，成人少见，主要变现为毒血症、休克和中毒性脑病为主，发病24小时内可出现痢疾样大便。败血症（P227）（C错）的主要变现为寒战、高热伴全身不适、头痛、肌肉关节痛，躯干、四肢、口腔黏膜及眼结膜处瘀点，膝关节等大关节红肿、疼痛、活动受限，肝脾肿大等。伤寒（P149）（D错）主要表现为持续发热、表情淡漠、相对缓脉、玫瑰疹、肝脾大和白细胞减少。流行性脑脊髓膜炎（P207）（E错）主要表现为突发高热、剧烈头痛、频繁呕吐、皮肤黏膜瘀点、淤斑及脑膜刺激征。